牙列缺失后，常用来确定（牙合）平面，以恢复牙列及咬合关系的是
A. 鼻翼耳屏线
B. 鼻根耳屏线
C. 眶耳平面
D. 下颌下缘
E. 以上都不正确

正确答案：A。鼻翼耳屏线

解析：鼻翼耳屏线是指从一侧鼻翼中点到同侧耳屏中点的假想连线，该线与（牙合）平面平行，与眶耳平面的交角约15°。牙列缺失后，常参考该线来确定（牙合）平面，以恢复牙列及咬合关系。掌握“（牙合）分类及临床意义与面部结构”知识点。